下列不属于判断地方病的依据的是
A. 当地不同居民的发病率均高
B. 外地类似居民的发病率均低
C. 外地迁入该地的居民均不发病
D. 迁出该地的居民发病率下降
E. 当地动物中也可能发生类似疾病

正确答案：C。外地迁入该地的居民均不发病

解析：本题考查判断地方病的依据。判断一种疾病是否属于地方性疾病的依据是：①该地区的居民发病率高（A对）。②其他地区居住的人群发病率低（B对），甚至不发病。③迁入该地区一段时间后，其发病率和当地居民一致（C错，为本题正确答案）。④迁出该地区后，发病率下降（D对），患病症状减轻或自愈。⑤当地的易感动物也可发生同样的疾病（E对）。